消化道出血时，一旦出现呕血，提示胃内贮积的血量为
A. 5～20mL
B. 50～70mL
C. 250～300mL
D. 500～800mL
E. 800～1000mL

正确答案：C。250～300mL

解析：消化道出血时，一旦出现呕血，提示胃内贮积的血量为300mL（C对）。出血5mL时可出现大便隐血试验阳性（A错）。出血量达60mL以上时可出现黑粪（B错）。出血量达400mL以上可出现周围循环障碍相关表现（D错）。出血量达800～1000mL（E错）时可出现周围循环衰竭表现。